医学道德评价方式
A. 良心
B. 社会舆论
C. 组织与政府评价
D. 以上都是
E. 以上均非

正确答案：D。以上都是

解析：社会舆论的评价方式主要有四个方面：社会舆论，同行评价，组织与政府评价，良心（D对）。社会舆论是指对某一引起公众共鸣的问题、相当数量的公众表达出相类似的倾向性态度，往往具有较强烈的道德色彩，以拥护或反对、赞扬或谴责的方式，对某一公共问题背后的社会主体作公开评价。同行评价也叫同行评议，即医学界同行对某个具体的医务人员或团体的医学道德行为进行公开或私下评价的过程及结果。组织评价一般依据政府主管部门、卫生行业组织、本单位等制定的各类医务人员从业规范，通过表扬先进的方式提倡高尚的职业道德行为，通过暂停、取消执业医师资格等方式维护医学行业的纯洁性。良心是医务人员自身内部的道德评价，是自己对自己的医学伦理行为道德价值的意识，简言之就是自我道德评价。